咀嚼肌检查的内容
A. 扪诊
B. 有无压痛
C. 压痛点的部位
D. 肌肉收缩的强度及对称性
E. 以上都对

正确答案：E。以上都对

解析：咀嚼肌检查的内容：通常是对咬肌和颞肌进行扪诊，检查有无压痛及压痛点的部位。同时嘱患者咬紧，检查肌肉收缩的强度及左右对称性，判断有无因干扰而引起的咀嚼肌功能紊乱，如发现问题则须对颌面部及颈部诸肌扪诊，必要时作进一步检查。掌握“修复学临床检查”知识点。